急性弥漫性增生性肾小球肾炎不明显的是
A. 镜下可见驼峰状致密物
B. 毛细血管壁增厚
C. 中性粒细胞浸润
D. 系膜细胞増生
E. 肾小球毛细血管内皮增生

正确答案：B。毛细血管壁增厚

解析：急性弥漫性增生性肾小球肾炎的病变特点是弥漫性毛细血管内皮细胞（E对）和系膜细胞（D对）增生，伴中性粒细胞（C对）和巨噬细胞浸润，电镜下可见驼峰状致密物（A对）。毛细血管壁增厚（B错，为本题正确答案）主要见于膜性肾小球病（P268）。